关于热原性质的叙述，正确的有
A. 热原具有水溶性
B. 热原具有不挥发性
C. 热原具有耐热性
D. 热原能被强酸、强碱、强氧化剂破坏
E. 热原可被活性炭、石棉板等吸附

正确答案：A、B、C、D、E。热原具有水溶性；热原具有不挥发性；热原具有耐热性；热原能被强酸、强碱、强氧化剂破坏；热原可被活性炭、石棉板等吸附

解析：本题考查热原的基本性质。关于热原性质的叙述，正确的有热原具有水溶性（A对）、热原具有不挥发性（B对）、热原具有耐热性（C对）、热原能被强酸、强碱、强氧化剂破坏（D对）、热原可被活性炭、石棉板等吸附（E对）。热原的基本性质：1.耐热性；2.水溶性；3.不挥发性；4.滤过性；5.被吸附性：热原可以被活性炭、纸浆滤饼等吸附。热原在水溶液中带有电荷，也可被某些离子交换树脂吸附；6.其他性质：热原能被强酸、强碱破坏，也能被强氧化剂如高锰酸钾或过氧化氢等破坏，超声波及某些表面活性剂也能使之失活。